哪类降压药兼有改善肾功，心功逆转心脏肥大，并能明显降低病死率
A. 可乐宁等中枢性降压药
B. 钙离子通道阻滞剂
C. 血管紧张素转换酶抑制药
D. 利尿降压药
E. 神经节阻断药

正确答案：C。血管紧张素转换酶抑制药

解析：血管紧张素转换酶抑制药作用如下：①抑制ACE活性；②对血流动力学的影响：降低血管阻力，改善心脏舒张功能。可降低肾血管阻力，增加肾血流量，增加肾小球滤过率，使尿量增加，达到缓解CHF症状的目的；③抑制心肌肥厚及血管重构：在血压未降的情况下，ACEI已表现出抗重构效应，能有效的阻止和逆转心室重构，肥厚和心肌纤维化，也能够逆转已出现的组织和肌层内冠脉壁的增厚，提高血管顺应性；④抑制交感神经活性；⑤保护血管内皮细胞功能。掌握“抗高血压药”知识点。